女，35岁，初产妇。妊娠34周，心慌，不能平卧一天。查体：P120次/分，R30次/分，BP140/90mmHg，心界向左下扩大，双肺满布湿啰音，胎心率145次/分。正确的处理措施是
A. 纠正心衰后治疗
B. 纠正心衰同时剖宫产
C. 纠正心衰后引产
D. 纠正心衰后剖宫产
E. 纠正心衰同时破膜引产

正确答案：D。纠正心衰后剖宫产

解析：初产妇心慌，不能平卧，心界向左下扩大，双肺满布湿啰音，应诊断为急性左心衰竭 NYHA Ⅳ级。对于妊娠晚期发生心力衰竭，治疗原则是待心力衰竭控制后再行产科处理，应放宽剖宫产指征，对于心功能NYHA Ⅲ-Ⅳ级者，均应剖宫产（D对），而不能纠正心衰后期待治疗（A错），不可纠正心衰同时剖宫产（B错）。胎儿仍存活且已过28周，胎肺已成熟，不可引产，故不能纠正心衰后引产（C错）或纠正心衰同时破膜引产（E错）。